男性，27岁。心悸气短，胸闷胸痛晕厥。查体：胸骨左缘第3肋间3/6收缩期杂音，超声检查显示室间隔：左室后壁为1.5：1，SAM（+）。肥厚型心肌病的治疗考虑
A. 安装DDD起搏器
B. 射频消融术
C. 狭窄处球囊成形术
D. 冠脉内旋支架术
E. 心肌打孔血运重建术

正确答案：A。安装DDD起搏器

解析：肥厚型心肌病非药物治疗包括手术治疗（室间隔切除术）、酒精室间隔消融术、起搏治疗。DDD起搏器（A对）属于双腔起搏器，起搏的是心房及心室，感知的是自身心房及心室信号，自身心房及心室信号被感知后抑制或触发起搏器在不应期内发放一次脉冲（P211），可用于药物治疗效果差而不太适合手术或消融的患者。射频消融术（P212）（B错）主要用于快速性心律失常的治疗。狭窄处球囊成形术主要用于冠状动脉、脑动脉等动脉狭窄的治疗（C错）。冠脉内旋支架术主要用于冠状动脉严重狭窄的治疗（D错）。心肌打孔血运重建术主要用于不适合“搭桥”和血管成型手术的缺血性心脏病的治疗（E错）。